乳房外侧部淋巴回流的主要途径是注入
A. 腋淋巴结胸肌群
B. 腋淋巴结尖群
C. 胸骨旁淋巴结
D. 纵隔前淋巴结
E. 膈上淋巴结

正确答案：A。腋淋巴结胸肌群

解析：腋淋巴结群包括胸肌淋巴结、肩胛下淋巴结、中央淋巴结、外侧淋巴结和尖淋巴结，乳房外侧淋巴结注入胸肌淋巴结，即腋淋巴结胸肌群（A对）。